归脾汤除益气补血外，还具有的功用是
A. 健脾养心
B. 补血调血
C. 敛阴止汗
D. 滋阴复脉
E. 益阴降火

正确答案：A。健脾养心

解析：本题考查归脾汤的功用，属记忆内容。归脾汤主治：1.心脾气血两虚证 2.脾不统血证。功用益气补血，健脾养心，由此可知（A对）。